某男，35岁。五一假期外出旅游，因天气忽冷忽热而感冒，症见发热、头痛、咳嗽、口干、咽喉疼痛，舌淡红、苔薄黄、脉浮数。医师诊断为风热感冒，并处以银翘解毒颗粒。服用3天，诸症悉除。银翘解毒颗粒处方的组成有金银花、连翘、薄荷、荆芥、淡豆豉、炒牛蒡子、淡竹叶、桔梗、甘草。炒牛蒡子在方中除散风清热、解毒消肿、利咽外，又能
A. 燥湿祛痰
B. 降气祛痰
C. 散结祛痰
D. 敛肺祛痰
E. 宣肺祛痰

正确答案：E。宣肺祛痰

解析：本题考查的是银翘解毒丸的方义简释。某男，35岁。五一假期外出旅游，因天气忽冷忽热而感冒，症见发热、头痛、咳嗽、口干、咽喉疼痛，舌淡红、苔薄黄、脉浮数。医师诊断为风热感冒，并处以银翘解毒颗粒。服用3天，诸症悉除。银翘解毒颗粒处方的组成有金银花、连翘、薄荷、荆芥、淡豆豉、炒牛蒡子、淡竹叶、桔梗、甘草。炒牛蒡子在方中除散风清热、解毒消肿、利咽外，又能宣肺祛痰（E对）。银翘解毒丸（颗粒、胶囊、软胶囊、片）：【方义简释】方中金银花甘寒清泄，轻香疏透；连翘苦能泄散，微寒能清，质轻上浮，相须同用，既疏散风热、清热解毒，又散结、辟秽，切中温热病邪易蕴结成毒及多夹秽浊之病机，故为君药。薄荷辛疏散，香辟秽，凉能清，善疏散风热、清利头目而利咽开音；炒牛蒡子辛散苦泄，寒清滑利，善散风清热、宣肺祛痰、解毒消肿、利咽；荆芥辛香微温发散，善散风发表；淡豆豉即用桑叶菊花水制者，其辛凉宣散，善疏散表邪。四药相合，既助君药疏风解表、清热解毒，又宣肺止咳、消肿利咽，故为臣药。淡竹叶即竹叶，其甘寒清利，辛散轻扬，善凉散上焦风热；桔梗辛散苦泄，质轻而平，善宣肺祛痰、止咳利咽；甘草生用甘补和缓，平而偏凉，能泻火解毒、调和诸药。三药相合，既增君臣药的疏风清热、解毒利咽之效，又宣肺祛痰止咳，还调和诸药，故为佐使药。全方配伍，疏散与清解并举，共奏疏风解表、清热解毒之功，故善治风热感冒所致的发热、头痛、咳嗽、口干、咽喉疼痛。